甲生物制品研发企业基于临床治疗需求，研发上市了一款针对PDL-1靶点用于肿瘤免疫治疗的新药，对多种肿瘤疾病疗效显著。为提升该药品的生产供应能力，甲计划在生产供应不足的情况下，同时委托乙药品生产企业生产，该新药销售由甲承担。甲的下列行为不符合国家规定的是
A. 甲聘请医药代表从事该抗肿瘤药的信息传递、沟通、反馈活动
B. 甲与其医药代表签订劳动合同，并及时做好备案信息维护
C. 甲对该肿瘤药的不良反应及时向疾病预防控制机构报告
D. 甲委托具有生物制品经营范围的药品批发企业销售该抗肿瘤药

正确答案：C。甲对该肿瘤药的不良反应及时向疾病预防控制机构报告

解析：本题考查药品不良反应的报告与处置的基本要求。甲的下列行为不符合国家规定的是甲对该肿瘤药的不良反应及时向疾病预防控制机构报告（C错，为本题正确答案）。药品生产、经营企业和医疗机构获知或者发现可能与用药有关的不良反应，应当通过国家药品不良反应监测信息网络报告；不具备在线报告条件的，应当通过纸质报表报所在地药品不良反应监测机构，由所在地药品不良反应监测机构代为在线报告。医药代表备案管理：医药代表，是指代表药品上市许可持有人在中华人民共和国境内从事药品信息传递、沟通、反馈的专业人员（A对），我国对医药代表实行备案管理（B对）。依法自行销售或委托销售药品：药品上市许可持有人可以自行销售其取得药品注册证书的药品，也可以委托药品经营企业销售。药品上市许可持有人从事药品零售活动的，应当取得药品经营许可证。药品上市许可持有人自行销售药品的，应当具备《药品管理法》第五十二条规定的条件；委托销售的，应当委托符合条件的药品经营企业（D对）。药品上市许可持有人和受托经营企业应当签订委托协议，并严格履行协议约定的义务。